在接触煤尘的工人中所发生的尘肺，可按其接尘中游离SiO₂含量的多少而有不同名称，其中哪一个是错误的
A. 单纯性煤尘肺（含游离SiO₂＞5%）
B. 煤肺（含游离SiO₂＜10%）
C. 煤矽肺（含游离SiO₂＞10%）
D. 煤工尘肺（同时接触煤尘及游离SiO₂混合尘的统称）
E. 矽肺（专门从事煤矿系统建井工人，主要接触含游离SiO₂极高者）

正确答案：A。单纯性煤尘肺（含游离SiO₂＞5%）